下列不符合关节型过敏性紫癜临床表现的是
A. 关节肿胀
B. 多发生于大关节
C. 部位固定，非游走性
D. 呈反复性发作
E. 不遗留关节畸形

正确答案：C。部位固定，非游走性

解析：关节型过敏性紫癜除皮肤紫癜外，因关节部位血管受累可表现为关节肿胀（A对）、疼痛、压痛及功能障碍，多发生于膝、踝、肘、腕等大关节（B对），呈游走性（C错，为本题正确答案）、反复性发作（D对），经数日而愈，不遗留关节畸形（E对）。